急性重症胆管炎并发休克，最重要的治疗措施是
A. 大量使用有效抗生素
B. 应用升压药物
C. 扩容治疗
D. 解除胆道梗阻，通畅引流
E. 纠正水电解质平衡紊乱

正确答案：D。解除胆道梗阻，通畅引流

解析：急性重症胆管炎的发病基础是胆道梗阻及细菌感染。如果在疾病发展过程中，胆道梗阻不能解除，胆管内细菌引起的感染得不到控制，将会危及患者生命。急性重症胆管炎并发休克，最重要的治疗措施是抗休克同时解除胆道梗阻，通畅引流（D对），可阻断病情的恶化。大量使用有效抗生素（A错）、应用升压药物（B错）、扩容治疗（C错）、纠正水电解质平衡紊乱（E错）均属于一般性非手术疗法，非手术疗法对这类病变梗阻的解除与脓灶引流实难奏效，且有延误加重病情的可能。